以下检验方法中，不属于非参数检验方法的是
A. 方差分析
B. 等级相关分析
C. Wilcoxon两样本秩和检验
D. Wilcoxon符号秩和检验
E. H检验

正确答案：A。方差分析